关于原核RNA聚合酶叙述正确的是
A. 原核RNA聚合酶有3种
B. 由4个亚基组成的复合物
C. 全酶中包括一个σ因子
D. 全酶中包括两个β因子
E. 全酶中包括一个α因子

正确答案：C。全酶中包括一个σ因子

解析：原核生物RNA聚合酶只有1种（A错），它由α₂（2个α）、β、β'、σ和ω5种亚基组成（BDE错）。α₂ββ’（ω）亚基合称核心酶，核心酶可催化NTP按模板的指引合成RNA，但核心酶合成的RNA没有固定的起始位点。σ亚基加上核心酶称为全酶（C对），σ亚基可辨认转录起始点，故加有σ亚基的全酶能在特定的起始点上开始转录。